以下哪项不是成釉细胞癌-原发型的组织学特点
A. 核分裂
B. 细胞多形性
C. 无神经症状
D. 局部坏死
E. 神经周浸润及核深染

正确答案：C。无神经症状

解析：成釉细胞癌-原发型在整体上表现成釉细胞瘤的组织学特点，细胞具有恶性特点，如细胞多形性、核分裂、局部坏死、神经周浸润及核深染。若有神经浸润，则会产生相应的神经症状。掌握“成釉细胞癌”知识点。